腹股沟直疝时，精索在疝囊
A. 左方
B. 右方
C. 前方
D. 后方
E. 内部

正确答案：C。前方

解析：直疝时精索在疝囊前外方（C对），腹股沟斜疝发生时精索位于疝囊后方（ABDE错）。